下列表现属于宫颈癌Ⅱ期的是
A. 原位癌
B. 癌局限在宫颈内
C. 超出宫颈，未及盆壁，侵及阴道上2/3
D. 癌侵及盆腔壁及阴道下1/3
E. 癌超越骨盆，或累及直肠膀胱

正确答案：C。超出宫颈，未及盆壁，侵及阴道上2/3

解析：宫颈癌Ⅱ期为肿瘤超出宫颈，但未及盆壁，侵及阴道上2/3（C对）。子宫颈癌临床分期：（1）Ⅰ期：肿瘤局限在子宫颈（扩展至宫体将被忽略）（B错）。（2）Ⅱ期：肿瘤超越子宫，但未达骨盆壁或未达阴道下1/3（C对）。（3）Ⅲ期：肿瘤已扩展到骨盆壁，在直肠指诊时，在肿瘤和盆壁之间无间隙。肿瘤累及阴道下1/3（D错），由肿瘤引起的肾盂积水或肾无功能的所有病例，除非已经知道由其他原因所引起。（4）Ⅳ期：肿瘤超出了真骨盆范围，或侵犯膀胱和（或）直肠黏膜（E错）。原位癌（A错）为0期。